骨折的专有体征是
A. 畸形
B. 疼痛与压痛
C. 局部肿胀
D. 功能障碍
E. 血运不良

正确答案：A。畸形

解析：骨折的专有体征包括畸形（A对）、异常活动、骨擦音或骨擦感。而疼痛与压痛（B错）、局部肿胀（C错）和功能障碍（D错）、血运不良（E错）均是骨折的一般表现，这些表现也可见于其他疾病（如炎症、肿瘤等），故不是骨折专有体征。